“医乃仁术”是指
A. 道德是医学的本质特征
B. 道德是医学活动中的一般现象
C. 道德是医学的非本质要求
D. 道德是医学的个别性质
E. 道德是个别医务人员的追求

正确答案：A。道德是医学的本质特征

解析：“医乃仁术”。仁爱之心是医学人道主义精神的实质，是实现医学目的的前提和根本，是医德的真正意义所在。“医乃仁术”是指道德是医学的本质特征（A对C错），而不是个别性质（D错）。道德适用于一切医学活动，而不是医学活动的一般现象（B错），是所有医务人员的普遍追求（E错）。